下列导致不合理用药因素中，不属于医师责任的是
A. 药物和治疗学知识不全面
B. 诊断技术和治疗水平不高
C. 对处方审查不严而调配错误
D. 给病人开处方时责任心不强
E. 对医学专业知识更新不及时

正确答案：C。对处方审查不严而调配错误